经典恒温法进行稳定性加速试验依据的公式是
A. Noyes-Whitney公式
B. Poiseuile公式
C. Henderson-Hasselbalch方程
D. Ostwald Freundlich方程
E. Arrhenius公式

正确答案：E。Arrhenius公式

解析：本题考查影响药物制剂稳定性的因素。Arrhenius公式（E对）是经典恒温法进行稳定性加速试验依据，是药物稳定性预测的主要理论依据，反映温度与反应速度间的定量关系。Noyes-Whitney公式（A错）是描述固体药物溶出速度的公式。Poiseuile公式（B错）用于描述液体滤速与滤过效率关系。Henderson-Hasselbalch方程（C错）用于描述弱酸弱碱性物质的解离型、非解离型及环境pH之间的关系。Ostwald Freundlich方程（D错）用于描述难溶性药物与粒子大小的定量关系。